患者男，腰背部疼痛20天，左侧膝关节、左下肢踝关节疼痛，晨起明显，活动后缓解，“4”字实验阳性，既往有虹膜炎病史。最可能的诊断是
A. 膝关节结核
B. 脊柱关节炎
C. 类风湿关节炎
D. 滑膜炎
E. 骨关节炎

正确答案：B。脊柱关节炎

解析：患者男，腰背部疼痛20天（强直性脊柱炎的首发症状），左侧膝关节、左下肢踝关节疼痛（附着点出现疼痛），晨起明显，活动后缓解（典型临床表现），“4”字实验阳性，既往有虹膜炎病史（关节外症状）。根据患者的临床表现，最可能诊断为强直性脊柱炎，强直性脊柱炎属于脊柱关节炎（B对）的最典型疾病。